下列关于局部麻醉药物的描述哪个是正确的
A. 心律失常患者常用的局麻药为酯类
B. 普鲁卡因的效能强度高于酰胺类局麻药
C. 阿替卡因适用于所有患者
D. 丁卡因常用于浸润麻醉
E. 利多卡因的常用阻滞麻醉浓度为1％～2％

正确答案：E。利多卡因的常用阻滞麻醉浓度为1％～2％

解析：本题考查局麻药。关于局部麻醉药物的描述正确的是利多卡因的常用阻滞麻醉浓度为1%～2%（E对）。利多卡因的常用阻滞麻醉浓度为1%～2%，是目前口腔科临床应用最多的局麻药。局麻药分为酯类和酰胺类，心律失常患者常用的局麻药为利多卡因，属于酰胺类（A错）。普鲁卡因（酯类）的效能强度为1作为标准，则酰胺类局麻药物的效能强度为1.5～8，故普鲁卡因的效能强度低于酰胺类局麻药（B错）。阿替卡因（酰胺类）适用于成人及4岁以上儿童而不是所有患者（C错）。丁卡因（酯类）易溶于水，穿透力强，主要用于表面麻醉；因其毒性大，一般不用于浸润麻醉（D错）。